有关处方书写的正确论述中，除外的是
A. 中药饮片处方的书写，一般应当按照君、臣、佐、使的顺序排列
B. 调剂、煎煮的特殊要求注明在药品右下方
C. 开具西药、中成药处方，每一种药品应当另起一行
D. 对饮片的产地有特殊要求的，应当在药品名称之前写明
E. 调剂、煎煮的特殊要求需加括号，如布包、先煎等

正确答案：B。调剂、煎煮的特殊要求注明在药品右下方

解析：中药饮片处方的书写，一般应当按照“君、臣、佐、使”的顺序排列；调剂、煎煮的特殊要求注明在药品右上方，并加括号，如布包、先煎、后下等；对饮片的产地、炮制有特殊要求的，应当在药品名称之前写明。掌握“处方管理概述及一般规定、处方权”知识点。